患者30岁，因左侧下后牙反复肿痛就诊。查：左下5无龋，（牙合）面磨损可见牙本质暴露，探无反应，叩（+），X线：根尖病变，根尖孔呈喇叭口状。造成该牙的原因可能为
A. 磨损
B. 牙隐裂
C. 畸形中央尖
D. （牙合）创伤
E. 釉质发育不全

正确答案：C。畸形中央尖

解析：本题考查畸形中央尖。患者30岁，因左侧下后牙反复肿痛就诊。查：左下5无龋，（牙合）面磨损可见牙本质暴露，探无反应，叩（+），X线：根尖病变，根尖孔呈喇叭口状。造成该牙的原因可能为畸形中央尖（C对）。根据病例描述，左侧下后牙反复肿痛就诊，左下5X线：根尖病变，根尖孔呈喇叭口状，可知左下5的根尖未发育完成，根据患者年龄，考虑是由于左上5在根尖未发育完成时牙髓坏死导致根尖不能继续发育所致；左下5未见龋坏，则不考虑是由龋病引起的牙髓炎症坏死；左下5（牙合）面磨损可见牙本质暴露，探无反应，可推测左下5处磨损后有修复性牙本质形成，综合考虑，初步诊断左下5为畸形中央尖，其早期发生中央尖的磨损露髓，导致牙髓感染坏死，使根尖不能继续发育完成。磨损一般可导致牙齿的尖窝沟嵴模糊，牙本质外露，引起牙本质敏感（A错）。牙隐裂主要表现为长期的咬合不适和咬在某一特殊部位时的剧烈疼痛（B错）。（牙合）创伤主要由不正常的牙合接触关系或过大的（牙合）力导致，病例中无相关依据，故不考虑（牙合）创伤的可能（D错）。釉质发育不全（E错）主要表现为釉质表面有边界比较明确的白垩色斑或棕色带状或窝状的凹陷。